对病因不明的疾病，描述性研究的主要任务
A. 因果推断
B. 寻找病因线索，提出病因假设
C. 验证病因
D. 确定病因
E. 以上均不是

正确答案：B。寻找病因线索，提出病因假设

解析：本题考查描述性研究的用途。描述性研究的用途为：①描述疾病或者健康状况的分布及发生发展的规律；②获得病因线索，提出病因假设（B对ACDE错）。